一单位发生食物中毒，部分职工吃过一家快餐，症状为：面色潮红，胸痛，胸闷，心慌，恶心，呕吐。经询问，快餐内有“青皮红肉鱼”。请问中毒的原因为
A. 氰苷
B. 龙葵素
C. 组胺
D. 亚硝酸盐
E. 组氨酸

正确答案：C。组胺

解析：当摄入海产鱼中的青皮红肉鱼类（富含组氨酸），如鲣鱼、鲐鱼、秋刀鱼、沙丁鱼、鲭鱼、竹荚鱼、金枪鱼等鱼类可引起组胺中毒（C对E错）。植物性有毒食品来源主要有3种：①将天然含有有毒成分的植物或其加工制品当作食品，如桐油、大麻油等；②在加工过程中未能破坏或除去有毒成分的植物性食品，如四季豆、木薯、苦杏仁等；③在—定条件下，产生了大量有毒成分的植物性食品，如发芽马铃薯等（AB错）。亚硝酸盐中毒是指进食了含有较大量的亚硝酸盐食物后，在短期内引起的以高铁血红蛋白血症为主的全身性疾病（D错）。